暑邪伤人，常见胸闷四肢困倦等症状的主要原因是
A. 暑邪夹湿，气滞湿阻
B. 暑性升散，汗多伤津，肢体失养
C. 暑性升散，伤津耗气
D. 暑性炎热，伤人后出现一系列阳热症状
E. 以上均非

正确答案：A。暑邪夹湿，气滞湿阻

解析：暑多挟湿，暑季气候炎热，且常多雨而潮湿，热蒸湿动，水气弥漫，故暑邪致病，多挟湿邪为患。其临床表现除发热、烦渴等暑热症状外，常兼见身热不扬，汗出不畅，四肢困重，倦怠乏力，胸闷呕恶（A对E错）。暑为阳邪，其性升发，故易上扰心神，或侵犯头目，出现心胸烦闷不宁，头昏，目眩、面赤等。"散"，指暑邪侵犯人体，可致腠理开泄而多汗（BC错）。暑为盛夏火热之气所化，火热属阳，故暑邪为阳邪。暑邪伤人多表现为一系列阳热症状，如高热、心烦、面赤、脉洪大等（D错）。